下列属于副交感神经的作用
A. 瞳孔增大
B. 糖原分解增加
C. 逼尿肌收缩
D. 骨骼肌血管舒张
E. 消化道括约肌收缩

正确答案：C。逼尿肌收缩

解析：副交感神经系统的作用意义主要在于保护机体、修整恢复、促进消化、积蓄能量以及加强排泄和生殖功能等，因此逼尿肌收缩（C对）（促进排尿）属于副交感神经的作用。瞳孔增大（A错）、糖原分解增加（B错）、骨骼肌血管舒张（D错）、消化道括约肌收缩（E错）属于交感神经的作用。